治疗无血流动力学阻碍的持续性室速，下列药物应首选
A. 毛花苷丙
B. 腺苷
C. 利多卡因
D. 地尔硫䓬
E. 比索洛尔

正确答案：C。利多卡因

解析：室速是指起源于希氏束分支以下的特殊传导系统或者心室肌的连续3个或3个以上的异位心搏，对于无显著血流动力学障碍的持续性室速，可选用利多卡因（C对）或胺碘酮，但应严格监测生命体征。毛花苷丙（A错）常用于控制心功能不全合并快速性房扑或房颤的心室率。腺苷（B错）、地尔硫䓬（D错）常用于控制折返性室上性心动过速。比索洛尔（E错）可减慢心室率，也可用于持续性室速，降低冠心病、心力衰竭患者死亡率，但易诱发低血压、心动过缓、各种心律失常，不作为首选。